经国务院药品监督管理部门指定药品检验机构检验合格方能进口的是
A. 国内供应不足的药品
B. 新发现和从国外引种的药材
C. 有关部门规定的生物制品
D. 生产新药或已有国家标准的药品
E. 没有实施批准文号管理的中药材

正确答案：C。有关部门规定的生物制品

解析：本题考查药品进口管理。经国务院药品监督管理部门指定药品检验机构检验合格方能进口的是有关部门规定的生物制品（C对）。国务院药品监督管理部门对下列药品在销售前或者进口时，应当指定药品检验机构进行检验；未经检验或者检验不合格的，不得销售或者进口：（一）首次在中国境内销售的药品；（二）国务院药品监督管理部门规定的生物制品；（三）国务院规定的其他药品。